白芥子的功效是
A. 燥湿化痰，祛风止痉
B. 开宣肺气，祛痰排脓
C. 止咳平喘，润肠通便
D. 温肺祛痰，利气散结
E. 清热化痰，凉血安胎

正确答案：D。温肺祛痰，利气散结

解析：本题考查的是芥子的功效。白芥子的功效是温肺祛痰，利气散结（D对）。白芥子即芥子。芥子：【功效】温肺祛痰，利气散结，通络止痛。白附子：【功效】燥湿化痰，祛风止痉（A错），解毒散结。桔梗：【功效】宣肺，利咽，祛痰，排脓（B错）。苦杏仁：【功效】降气止咳平喘，润肠通便（C错）。竹茹：【功效】清热化痰，除烦止呕，安胎（E错）。